在等容舒张期，心脏各瓣膜的功能状态是
A. 房室瓣关闭，动脉瓣开放
B. 房室瓣开放，动脉瓣关闭
C. 房室瓣关闭，动脉瓣关闭
D. 房室瓣开放，动脉瓣开放
E. 二尖瓣关闭，三尖瓣开放

正确答案：C。房室瓣关闭，动脉瓣关闭